下列低容量性低钠血症对机体的影响，哪项是不正确的？
A. 细胞外液减少，易发生休克
B. 无口渴感
C. 早期便有ADH分泌增多，晚期ADH分泌减少
D. 有明显失水体征
E. 肾外因素所致失钠者，尿Na⁺含量减少

正确答案：C。早期便有ADH分泌增多，晚期ADH分泌减少

解析：低容量性低钠血症即低渗性脱水。低渗性脱水特点为失钠多于失水，细胞外液渗透压降低，对口渴中枢无明显刺激，无口渴感（B对），水向细胞内转移，加重细胞外液的丢失，而易发生休克（A对）。血浆渗透压降低使抗利尿激素分泌减少，故早期尿量无明显减少（C错，为本题正确答案）。但在晚期血容量显著降低时，ADH释放增多，肾小管对水的重吸收增加，可出现少尿。由于血容量减少，组织间液向血管内转移，使组织间液减少更为明显，因而患者皮肤弹性减退，眼窝和婴幼儿囟门凹陷（D对）。低血容量可激活肾素-血管紧张素-醛固酮系统，加强肾保钠保水排钾作用，结果导致尿Na⁺含量减少（E对）。